某病发病率超过该地一定历史条件下的流行水平
A. 暴发
B. 流行
C. 散发
D. 大流行
E. 有季节性

正确答案：D。大流行

解析：大流行：当疾病迅速蔓延，涉及地域广，短时间内可跨越省界、国界或洲界，发病率超过该地一定历史条件下的流行水平，称为大流行。掌握“流行病学资料与疾病分布”知识点。